人产生心理障碍及心身疾病的主要的认知心理因素错误的是
A. 感觉
B. 信念
C. 记忆
D. 动机
E. 情感

正确答案：B。信念

解析：人的心理或心理现象分为基本的心理过程和个性特征两个方面。心理过程包括认知过程、情感过程（E对）与意志过程，认识过程又包括感觉（A对）、知觉、记忆（C对）、思维、想象等。需要、动机（D错）、兴趣、观点、信念（B错，为本题正确答案）属于个性特征中的人格倾向性，不属于认知心理因素。本题正确答案应为B和D。